利尿药治疗慢性心功能不全的主要药理依据是
A. 首选呋塞米，并与排钾利尿药合用
B. 促进Na⁺和水的排出，减轻心脏的负荷
C. 增加血容量
D. 增加血管平滑肌张力
E. 促进Na⁺-Ca²⁺交换

正确答案：B。促进Na⁺和水的排出，减轻心脏的负荷

解析：利尿剂可抑制肾小管对钠、水的重吸收遏制心衰时的钠潴留，减少静脉回流和降低心脏前负荷，从而减轻肺淤血，提高运动耐量（B对）。